患者初起恶寒发热，咽痛，眼睑浮肿，小便不利，经治后，表虽解，但肿势末退，身重困倦，胸闷，纳呆泛恶，苔白腻，脉沉缓，最佳选方是
A. 越婢加术汤
B. 猪苓汤
C. 五皮饮合胃苓汤
D. 苓桂术甘汤
E. 防己黄芪汤

正确答案：C。五皮饮合胃苓汤

解析：患者刻下症状仍以水肿为主要表现，水湿之邪，浸渍肌肤，壅滞不行，以致肢体浮肿不退。水湿内聚，三焦决凟失司，膀胱气化失常，水湿日增而无出路，横溢肌肤，所以肿势日甚。脾为湿困，阳气不得舒展，故见身重神疲，胸闷，纳呆，泛恶等症。苔白腻，脉沉缓，亦为湿胜脾弱之象，故诊断患者为水肿之水湿浸渍证，治以健脾化湿，通阳利水，选方五皮饮合胃苓汤（C对）。越婢加术汤为水肿之风水泛滥证的选方（A错）。猪苓汤为癃闭之肾阴亏耗证的主方（B错）。苓桂术甘汤为心悸之水饮凌心证的主方（D错）。水肿风水泛滥证若见汗出恶风，卫阳已虚，则用防己黄芪汤加减以益气行水（E错）。